易早期出现颅内高压症状的是
A. 额叶肿瘤
B. 颞叶肿瘤
C. 顶叶肿瘤
D. 枕叶肿瘤
E. 第四脑室肿瘤

正确答案：E。第四脑室肿瘤

解析：颅内肿瘤出现颅内压增高者约占80%以上。脑室或中线部位的肿瘤，虽然体积不大，但由于堵塞脑室间孔、中脑导水管或第Ⅳ脑室脑脊液循环通路，易产生梗阻性脑积水，因而颅内压增高症状可早期出现而且显著（ E对）。